对学校健康教育活动的长期效果进行评价，合适的指标是
A. 学生健康知识的知晓率的变化情况
B. 学生健康信念的形成率的变化情况
C. 学生健康行为的改善率
D. 学生健康活动的参与率
E. 学生因病缺课率的变化情况

正确答案：E。学生因病缺课率的变化情况